下列属于冠状动脉粥样硬化性心脏病主要危险因素的是
A. 脑力劳动者
B. 生活节奏快
C. 肥胖
D. 进取心强
E. 长期饮酒

正确答案：C。肥胖

解析：冠状动脉粥样硬化性心脏病主要危险因素有年龄性别、血脂异常、高血压、吸烟、糖尿病和糖耐量异常、肥胖（C对）、家族史。